某患者因腮腺良性肿瘤将于明日行腮腺浅叶切除术加面神经解剖术，今日术前家属签字时，谈话中以下哪项是不必要的
A. 术后可能出现面瘫
B. 耳垂麻木
C. 涎瘘
D. Frey综合征
E. 可能出现半侧下颌骨麻木

正确答案：E。可能出现半侧下颌骨麻木

解析：本题考查腮腺浅叶切除术加面神经解剖术。下牙槽神经受损可能出现半侧下颌骨麻木（E错，为本题的正确答案），但腮腺浅叶切除术不会损伤下牙槽神经。在行腮腺浅叶切除术和面神经解剖术时，若术中损伤面神经，术后可能出现面瘫（A对）；若术中损伤耳大神经，术后有可能出现耳垂麻木（B对）；若术中损伤了腮腺导管，术后可能发生涎瘘（C对）；若术中切断的耳颞神经中的副交感神经纤维与支配皮肤汗腺、表浅血管的交感神经纤维错位愈合，术后会出现Frey综合征（D对）。